女，30岁。半年来总担心双手有细菌而经常反复洗手，一天无数次总不放心，自知不对，又无法控制。此症状属于
A. 妄想
B. 强迫行为
C. 刻板动作
D. 情绪焦虑
E. 强制性思维

正确答案：B。强迫行为

解析：强迫行为（B对）指患者明知没有必要，却难以克制的去重复做某些动作行为，如果不重复，往往焦虑不安。患者半年来总担心双手有细菌而经常反复洗手，一天无数次总不放心，自知不对，又无法控制为强迫性洗涤。思维内容障碍主要表现为妄想（A错），它是在病态推理和判断基础上形成的一种病理性的歪曲信念。刻板动作（C错）指患者机械刻板地反复重复某一单调的动作，如长时间反复地将苹果拿起和放下。焦虑（D错） 是指在缺乏相应的客观刺激情况下出现的内心不安状态。强制性思维（E错）是思维联想的自主性障碍。表现为患者感到脑内涌现出大量无现实意义、不属于自己的联想，是被外力强加的。